修复体就位后牙龈组织变苍白，有压痛感主要是因为
A. 正常反应
B. 边缘过长
C. 边缘探针可探入
D. 边缘未达设计位置
E. 龈边缘与牙颈部肩台外形不一致

正确答案：B。边缘过长

解析：本题考查修复体试戴、磨光与粘固。边缘过长（B对），牙龈组织受压，变苍白，患者有压痛感，应做相应的调整。